受体而止吐的药物是
A. 多潘立酮
B. 昂丹司琼
C. 甲氧氯普胺
D. 西沙比利
E. 奥美拉唑

正确答案：C。甲氧氯普胺

解析：本题考查甲氧氯普胺。甲氧氯普胺（C对）可作用于中枢和外周的D₂受体，通过抑制中枢催吐化学感受区中D₂受体，提高该感受区的阈值产生镇吐作用；多潘立酮（A错）是通过直接阻断胃肠道D₂受体，提高胃肠道平滑肌对胆碱能的反应性；昂丹司琼（B错）为五羟色胺（5-HT₃）受体拮抗药，能有效地抑制或缓解由细胞毒性化疗药物和放疗引起的恶心呕吐；西沙比利（D错）是通过激动5-HT₄，促进乙酰胆碱的释放来促进胃肠动力；奥美拉唑（E错）为质子泵抑制剂，通过抑制H⁺，K⁺-ATP酶活性，从而抑制各种原因引起的胃酸生成。